具有促进其他药物透过血脑屏障作用的中药是
A. 丹参
B. 白芷
C. 冰片
D. 羌活
E. 银杏叶

正确答案：C。冰片

解析：本题考查的是中西药联用在药物相互作用。具有促进其他药物透过血脑屏障作用的中药是冰片（C对）。中西药联用影响分布：药物分布是指药物吸收后随血液循环分布到各组织间液和细胞内液的过程，与血浆蛋白结合率、血-脑屏障、胎盘屏障密切相关。某些中西药联用相互作用后，血药浓度有所变化，影响药物与血浆蛋白组织结合。碱性中药如硼砂、红灵散、女金丹、痧气散等，能使氨基糖苷类抗生素如链霉素、庆大霉素、卡那霉素、阿米卡星等排泄减少，吸收增加，血药浓度上升，药效增加20～80倍，同时增加脑组织中的药物浓度，使耳毒性增加，造成暂时性或永久性耳聋，故长时间联用应进行血药浓度监测。含有鞣质类化合物的中药在与磺胺类药物合用时，导致血液及肝脏内磺胺类药物浓度增加，严重者可发生中毒性肝炎。银杏叶（E错）与地高辛合用可促进主动脉内皮细胞内Ca²⁺水平升高，使地高辛的游离血药浓度明显升高，易造成中毒，因此，临床上两者联合使用时应适当降低地高辛剂量，并进行血药浓度的监测。香豆素类药物血浆蛋白结合率高，可以将口服降糖药甲苯磺丁脲置换出来而引起低血糖，独活、白芷（B错）、羌活（D错）等中药主含香豆素类成分，有可能发生此类安全性风险。又如中药丹参（A错）、黄连、黄柏等通过与血浆蛋白竞争性结合影响华法林的药效作用，甚至中药能够直接改变病理状态下患者的血浆蛋白水平，从而引发未知相互作用风险。麝香、苏合香、冰片等开窍药都具有提高药物血-脑屏障通透率的作用，尤其与作用于中枢神经系统药物联用时，必要时需要监测西药血药浓度。